张某，58岁，患有2型糖尿病，进行体育锻炼的靶心率为
A. 60次/分钟
B. 90次/分钟
C. 112次/分钟
D. 120次/分钟
E. 130次/分钟

正确答案：C。112次/分钟

解析：本题考查糖尿病病人进行体育锻炼的靶心率。糖尿病病人可根据自己的身体状况，选择合适的运动方式，运动强度以接近靶心率（能获得较好运动效果并能保证安全的运动心率）为准。本题中该患者58岁，靶心率＝170－年龄（岁）＝170－58＝112次/分钟（C对ABDE错）。